一旦发生药物不良反应，首先要停用一切药物，并
A. 进行洗胃
B. 进行透析
C. 同时禁食
D. 无须特殊处理
E. 采取对症治疗

正确答案：C。同时禁食